从病因推论的角度来看，系统综述是对Hill准则的应用和发展，其主要特点不包括
A. 强调了对原始研究收集的系统性
B. 强调了对原始研究证据真实性的评估
C. 强调了只有随机对照试验才是可靠的证据
D. 随机对照试验的系统综述在设计和分析要素中涵盖了Hill的主要准则
E. 提出了研究间一致性的定量评估方法

正确答案：C。强调了只有随机对照试验才是可靠的证据

解析：本题考查了系统综述的特点。系统综述的特点并没有强调了只有随机对照试验才是可靠的证据（C错，为本题正确答案），而加强了对原始研究收集的系统性（A对）以及对结果定量的推论,并在原始研究结果真实性（B对）、精确性和一致性方面，系统地提出了一套统一的定量评估方法（E对）。随机对照试验的系统综述在设计和分析要素中涵盖了Hill的主要准则，如时间顺序、关联强度、剂量-反应关系、实验证据、一致性等。